患儿，2岁。持续壮热5天，起伏如潮，肤有微汗，烦躁不安，目赤眵多，皮疹布发，疹点由细小稀少而逐渐稠密，疹色先红后暗，皮疹凸起，触之碍手，压之退色，大便干结，小便短少，舌质红赤，舌苔黄腻，脉数有力。治疗应首选
A. 宣毒发表汤
B. 清解透表汤
C. 沙参麦冬汤
D. 麻杏石甘汤
E. 羚角钩藤汤

正确答案：B。清解透表汤

解析：题中患儿前期高热5天，热盛后出疹，皮疹为暗红色，可诊断为麻疹。麻疹时邪炽盛于内，故壮热，麻疹的透发与发热密切相关，热势多呈起伏，称为“潮热”，且发热与微汗并见，热毒内扰心神，故烦躁不安，麻疹时邪内炽，火热盛于胃，故目赤眵多，大便干结，小便短少，皮疹凸起，触之碍手，压之退色为疹出的表现。舌质红赤，舌苔黄腻，脉数有力为邪热内盛之象，故辨为肺胃热盛证（出疹期）。宣毒发表汤能辛凉透表，清宣肺卫，为麻疹邪犯肺卫的选方（A错）。清解透表汤能清凉解毒，透疹达邪，为麻疹肺胃热盛的选方（B对）。沙参麦冬汤能养阴益气，清解余邪，为麻疹阴津耗伤的选方（C错）。麻杏石甘汤能宣肺开闭，清热解毒，为麻疹逆证邪毒闭肺证的选方（D错）。羚角钩藤汤能平肝息风，清心开窍，为麻疹逆证邪陷心肝证的选方（E错）。